协同致癌作用机理包括
A. 抑制DNA修复
B. 选择性增强DNA受损细胞的增殖
C. 活化作用酶系统活力发生改变
D. 上述AB正确

正确答案：D。上述AB正确

解析：本题考查协同致癌作用机理。协同致癌作用机理包括：抑制DNA修复和选择性增强DNA受损细胞的增殖（D对ABC错）。